矿物药的本色指的是
A. 由矿物的成分和内部结构所决定的颜色
B. 由外来的带色杂质、气泡等包裏体所引起的颜色
C. 矿物在白色毛瓷板上划过后留下的粉末痕迹的颜色
D. 由解理面或断口引起的反射光与入射光的干涉作用而产生的颜色
E. 由晶体内部裂缝及表面氧化膜的反射光引起与入射光的干涉作用而产生的颜色

正确答案：A。由矿物的成分和内部结构所决定的颜色

解析：本题考查的是矿物的颜色。矿物药的本色指的是由矿物的成分和内部结构所决定的颜色（A对）。矿物的颜色是指矿物对自然光线中不同波长的光波均匀吸收或选择吸收所表现的性质。矿物的颜色一般分为以下三种。（1）本色：是由矿物的成分和内部构造所决定的颜色，如辰砂的红色，石膏的白色。（2）外色：由外来的带色杂质、气泡等包裏体所引起的颜色（B错），与矿物自身的成分和构造无关。外色的深浅除与带色杂质的量有关外，还与杂质分散的程度有关，如紫石英、大青盐等。（3）假色：由晶体内部裂缝面、解理面及表面氧化膜的反射光引起与入射光波的干涉作用而产生的颜色（DE错），如云母的变彩现象。条痕及条痕色：矿物在白色毛瓷板上划过后所留下的粉末痕迹称为条痕，粉末的颜色（C错）称为条痕色。条痕色比矿物表面的颜色更为固定，更能反映矿物的本色，因而更具鉴定意义。有的矿物表面的颜色与粉末颜色相同，如朱砂，也有的是不相同的，如自然铜，表面为亮淡黄色或棕褐色，而粉末为绿黑色或棕褐色。